高压蒸汽灭菌法通常在103.4kpa的压力下维持时间为
A. 1～5分钟
B. 6～10分钟
C. 15～20分钟
D. 30～40分钟
E. 55～60分钟

正确答案：C。15～20分钟

解析：高压蒸气灭菌法通常在102.9kPa的压力和121℃的温度下进行，若物品为敷料，要达到灭菌效果所需最短时间为30分钟；若物品为器械，要达到灭菌效果所需最短时间为20分钟，即高压蒸汽灭菌法通常在102.9kPa的压力下维持时间为20～30分钟。而本题所问为在103.4kPa的压力下，压力略高，故所需时间应略短，因此15～20分钟为最佳答案（C对）。事实上，此数据来源于（八版医学微生物学P34）：在超过标准大气压103.4kPa（1.05kg/cm²）蒸汽压力下，温度达到121.3℃，维持15～20分钟，可杀灭包括细菌芽孢在内的所有微生物。